分子中含有呋喃甲酰基结构，为选择性的α₁受体拮抗剂，临床用于缓解前列腺增生症状的药物是
A. 甲磺酸多沙唑嗪
B. 盐酸阿夫唑嗪
C. 非那雄胺
D. 盐酸哌唑嗪
E. 盐酸特拉唑嗪

正确答案：E。盐酸特拉唑嗪

解析：本题考查缓解前列腺增生症状的药物。盐酸特拉唑嗪（E对）是α₁受体拮抗剂，对前列腺组织的选择性较高，使前列腺平滑肌舒张而防止尿道阻塞。临床用于治疗高血压和良性前列腺增生导致的排尿困难。